关于病毒性肝炎的流行病学，下列描述不正确的是
A. 乙型肝炎的传染源主要是患者及病毒携带者
B. 乙型肝炎主要是通过血液、体液、母婴接触传播
C. 甲型肝炎主要通过粪口途径传播
D. 胎盘球蛋白对甲、乙型肝炎均有较好的预防效果
E. 乙型肝炎可通过主动和被动免疫预防

正确答案：D。胎盘球蛋白对甲、乙型肝炎均有较好的预防效果